下列是教育青少年预防艾滋病的主要内容，除了
A. 遵守性道德，洁身自爱，不发生婚前或婚外性行为
B. 不输未经检测的血液和血制品
C. 接受任何注射和验血时使用一次性针具
D. 不与他人共用牙刷和剃须刀
E. 与艾滋病患者或感染者保持一定的距高

正确答案：E。与艾滋病患者或感染者保持一定的距高